皮下注射后约10～15分钟内起效，主要用于控制餐后血糖的胰岛素或胰岛素类似物是
A. 低精蛋白锌胰岛素
B. 预混胰岛素类似物（预混门冬胰岛素30）
C. 甘精胰岛素
D. 预混胰岛素（30R）
E. 赖脯胰岛素

正确答案：E。赖脯胰岛素

解析：本题考查赖脯胰岛素。皮下注射后约10～15分钟内起效，主要用于控制餐后血糖的胰岛素或胰岛素类似物是赖脯胰岛素（E对）。低精蛋白锌胰岛素（A错）用于一般中、轻度糖尿病患者，重症须与胰岛素合作，每日早餐前30～60分钟皮下注射一次，有时需于晚餐前再注射一次，必需时可与胰岛素混合使用，剂量根据病情而定。预混胰岛素类似物(预混门冬胰岛素30）（B错）皮下注射后约0.17～0.33小时内起效，可以较好的控制餐后高血糖。甘精胰岛素（C错）皮下注射后约2～3小时内起效，用于需用胰岛素治疗的糖尿病。预混胰岛素(30R）（D错）皮下注射后约0.5小时内起效，可以较好的控制餐后高血糖。